肝素抗凝作用的主要机制是
A. 直接灭活凝血因子
B. 与血中Ca²⁺结合
C. 抑制肝脏合成凝血因子
D. 激活纤溶酶原
E. 提高血浆中的ATⅢ活性

正确答案：E。提高血浆中的ATⅢ活性

解析：带负电荷的肝素可与带正电荷的ATⅢ的赖氨酸残基形成可逆性复合物，使ATⅢ发生构型的改变，更充分地暴露出其活性中心，ATⅢ则以精氨酸残基迅速与丝氨酸蛋白酶活性中心的丝氨酸残基结合，从而加速ATⅢ对凝血因子Ⅱa、Ⅸa、Xa、Xa 和Ma等的灭活（E对）。